蔬菜水果中不含有
A. 维生素A
B. 硫胺素
C. 核黄素
D. 维生素C
E. 胡萝卜素

正确答案：A。维生素A